善治肺热咳喘的药是
A. 黄连
B. 黄芩
C. 黄柏
D. 苦参
E. 土茯苓

正确答案：B。黄芩

解析：本题考查的是黄芩的主治病证。善治肺热咳喘的药是黄芩（B对）。黄芩：【主治病证】（1）湿温，暑湿，湿热胸闷、黄疸、泻痢、淋痛、疮疹。（2）热病烦渴，肺热咳喘，少阳寒热，咽痛，目赤，火毒痈肿。（3）血热之吐血、咳血、衄血、便血、崩漏。（4）胎热之胎动不安。黄连（A错）：【主治病证】（1）湿热痞满、呕吐、泻痢、黄疸。（2）热病高热、烦躁、神昏，内热心烦不寐，胃火牙痛、口舌生疮。（3）肝火犯胃之呕吐吞酸。（4）血热妄行吐衄，痈疽肿毒，目赤肿痛，耳道疖肿，湿热疮疹。黄柏（C错）：【主治病证】（1）湿热下注之带下、淋浊、脚气、足膝红肿。（2）湿热黄疸，湿热泻痢，湿疹，湿疮。（3）热毒疮肿，口舌生疮，血热出血。（4）阴虚之盗汗遗精，骨蒸潮热。苦参（D错）：【主治病证】（1）湿疮，湿疹，疥癣，麻风，阴痒，带下。（2）湿热黄疸、泻痢、便血。（3）湿热淋痛，小便不利。土茯苓（E错）：【主治病证】（1）梅毒，或因患梅毒服汞剂而致肢体拘挛者。（2）淋浊，带下，脚气，湿疹，湿疮。